嗜酸性粒细胞增多可见于
A. 荨麻疹或血管神经性水肿
B. 牛皮癣、湿疹、天疱疮
C. 肺吸虫病、钩虫病、血吸虫病
D. 嗜酸性粒细胞白血病
E. 高脂血症

正确答案：A、B、C、D。荨麻疹或血管神经性水肿；牛皮癣、湿疹、天疱疮；肺吸虫病、钩虫病、血吸虫病；嗜酸性粒细胞白血病

解析：本题考查嗜酸性粒细胞增多。嗜酸性粒细胞增多：①过敏性疾病：支气管哮喘、荨麻疹、药物性皮疹、血管神经性水肿（A对）、食物过敏、血清病、过敏性肺炎等。②皮肤病与寄生虫病：牛皮辦、湿疹、天疱疮（B对）、疱疹样皮炎、真菌性皮肤病、肺吸虫病（C对）、钩虫病、包虫病、血吸虫病、丝虫病、绦虫病等。③血液系统疾病：慢性粒细胞白血病、嗜酸性粒细胞白血病（D对）等。④药物：应用头孢拉定、头孢氨苄、头孢呋辛钠、头孢哌酮等抗生素。⑤恶性肿瘤：某些上皮性来源肿瘤如肺癌等。⑥传染病：猩红热。⑦其他：风湿性疾病、肾上腺皮质功能减退症等。